男，45岁，身高171cm，体重85kg，口服葡萄糖耐量试验血糖结果：空腹6.7mmol/L，1小时9.8mmol/L，2小时7.0mmol/L。结果符合
A. 正常曲线
B. 空腹血糖受损
C. 糖耐量低
D. 1型糖尿病
E. 2型糖尿病

正确答案：B。空腹血糖受损

解析：患者空腹血糖6.7mmol/L且口服葡萄糖耐量试验2小时血糖7.0mmol/L（正常值：＜7.8mmol/L）。空腹血糖受损诊断标准为：空腹血糖6.1～7.0mmol/L且口服糖耐量试验2小时血糖在正常范围，因此本例患者符合空腹血糖受损（B对）的诊断。空腹血糖正常值（A错）为3.9～6.0mmol/L，本例患者空腹血糖大于正常范围；糖耐量减低（C错）诊断标准为空腹血糖小于7.0mmol/L，且口服糖耐量试验2小时血糖为7.8～11.1mmol/L。糖尿病（DE错）诊断标准为空腹血糖≥7mmol/L，OGTT2h≥11.1mmol/L。